新生儿金黄色葡萄球菌败血症治疗首选
A. 万古霉素
B. 阿米卡星
C. 甲硝唑
D. 青霉素
E. 氨苄西林

正确答案：A。万古霉素

解析：新生儿败血症：金黄色葡萄球菌感染用万古霉素和青霉素，青霉素很容易产生耐药性厌氧菌，故金黄色葡萄球菌感染首选万古霉素（A对D错）；厌氧菌感染选用甲硝唑（C错）；流感嗜血杆菌感染选用氨苄西林（E错）。阿米卡星肾毒性太大，儿科很少用此药（B错）。